在突触传递过程中，引起递质释放的关键因素是
A. 前膜内轴质黏度的高低
B. 突触前膜发生去极化
C. 兴奋传到神经末梢
D. 前膜内侧负电位的大小
E. Ca²⁺进入突触前末梢

正确答案：E。Ca²⁺进入突触前末梢